女婴，10个月。腹泻3天，加重2天。暗红色水样便每日10余次，量多，腥臭，伴高热、呕吐、少尿。查体：精神萎靡，呈嗜睡状，前卤眼窝凹陷，皮肤弹性差，心音较低钝，腹胀，肝脾不大。实验室检查：粪镜检有大量脓血细胞，血钠135mmol/L，血钾3.5mmol/L。对该患儿最不适合的处理是
A. 使用止泻剂
B. 选用有效的抗生素
C. 使用微生态制剂
D. 继续饮食
E. 使用肠黏膜保护剂

正确答案：A。使用止泻剂

解析：本例患儿腹泻、暗红色水样便、量多、腥臭、高热、呕吐、少尿，精神萎靡呈嗜睡状，前囟眼窝凹陷，皮肤弹性差，心音较低钝，腹胀，最可能的诊断是大肠埃希菌肠炎。对于大肠埃希菌肠炎等感染性腹泻，可以进行控制感染的治疗，如选用有效的抗生素（B对）；使用微生态制剂（C对）有助于恢复肠道正常菌群的生态平衡；继续饮食（D对）满足生理需要，补充疾病消耗，缩短腹泻后的康复时间；使用肠黏膜保护剂（E对）吸附病原体和毒素，维持肠细胞的吸收和分泌功能，阻止病原微生物的攻击。腹泻本身是人体对感染胃肠道细菌的代偿反应，可通过腹泻排除部分病原体及其产生的毒素，止泻剂本身是抑制胃肠动力药物，不利于排除部分病原体及其产生的毒素，是对该患儿最不适合的处理（A错，为本题正确答案）。